男，33岁，右颈上部无痛性肿块半年。体检见右颈上部乳突肌前缘及表面有一肿块，囊肿表面光滑，质地软，表面皮肤色泽正常，穿刺液体为棕色清亮的液体。最可能的临床诊断为
A. 鳃裂囊肿
B. 囊性水瘤
C. 甲状舌管囊肿
D. 口外型舌下腺囊肿
E. 海绵型淋巴管瘤

正确答案：A。鳃裂囊肿

解析：本题考查口腔颌面部软组织囊肿。根据题干男，33岁，右颈上部无痛性肿块半年。体检见右颈上部乳突肌前缘及表面有一肿块，囊肿表面光滑，质地软，表面皮肤色泽正常，穿刺液体为棕色清亮的液体。最可能的临床诊断为鳃裂囊肿（A对）。鳃裂囊肿：位于面颈部侧方。肿块大小不定，生长缓慢，患者无自觉症状，如发生上呼吸道感染后可以骤然增大，则感觉不适。鳃裂囊肿可根据病史、临床表现及穿刺检查作出诊断。作穿刺抽吸时，可见有黄色或棕色的、清亮的、含或不含胆固醇的液体。鳃裂瘘可时有黏液样分泌物（第一鳃裂瘘可伴有皮脂样分泌物）溢出。行造影检查可以明确其瘘管走向，协助诊断。囊性水瘤（B错）：大囊型淋巴管畸形即传统分类中的囊肿型或囊性水瘤。主要发生于颈部、锁骨上区，亦可发生于下颌下区及上颈部。一般为多房性囊腔，彼此间隔，内有透明、淡黄色水样液体。当伴有出血或感染时，穿刺液可为血性或脓性。病损大小不一，表面皮肤色泽正常，呈充盈状态，扪诊柔软，有波动感。与深部血管瘤不同的是体位移动试验阴性，但透光试验阳性。甲状舌管囊肿（C错）：可根据其部位和随吞咽移动等而作出诊断。有时穿刺检查可抽出透明、微混浊的黄色稀薄或黏稠性液体。对甲状舌管瘘还可行碘油造影以明确其瘘管行径。口外型舌下腺囊肿（D错）：又称潜突型，主要表现为下颌下区肿物，而口底囊肿表现不明显。触诊柔软，与皮肤无粘连，不可压缩。囊肿内容物为蛋清样黏稠液体。海绵型淋巴管瘤（E错）：是由原始淋巴管发育增生形成的肿物，是一种先天性发育畸形，属于错构瘤性质，是肿瘤和畸形之间交界性病变。该病多见于儿童，一般不自行消退，但病程缓慢。发生部位以头颈部为多，主要表现为可压缩性的皮内或皮下的囊性肿物。